对腹部实质性脏器病变最简便易行的检查方法是
A. X线摄片
B. CT扫描
C. 同位素扫描
D. B型超声波检查
E. 纤维内窥镜检查

正确答案：D。B型超声波检查

解析：腹部实质性脏器主要包括肝、胆、胰、脾，对这些实质性脏器病变最简便易行的检查方法是B型超声波检查（D对）。X线摄片（A错）、纤维内窥镜检查（E错）较少用于检查腹部实质性脏器病变。CT扫描（B错）、同位素扫描（C错）多用于腹部实质性脏器的进一步检查，一般不作为首选检查。